下面不属于伤害预防策略三级预防中的一级预防的是
A. 开展伤害预防的健康教育
B. 现场紧急救助
C. 交通安全法律
D. 有毒物品的安全盖
E. 游泳池周围设立栅栏

正确答案：B。现场紧急救助

解析：本题考查伤害预防策略的三级预防。一级预防的目标是通过减少能量传递或暴露的机制来预防可导致伤害发生的事件。开展伤害预防的健康教育（A对），交通安全法律（C对），有毒物品的安全盖（D对），游泳池周围设立栅栏（E对）都属于一级预防措施。三级预防指伤害已经发生后控制伤害的结果，现场紧急救助（B错，为本题正确答案）属于三级预防措施。